饮用水卫生标准规定，用氯消毒时
A. 接触1～2小时，游离性余氯不低于2mg/L
B. 接触1～2小时，游离性余氯不低于0.2mg/L
C. 接触0.5小时，化合性余氯不低于0.5mg/L
D. 接触0.5小时，游离性余氯不低于2mg/L
E. 接触0.5小时，游离性余氯不低于0.3mg/L

正确答案：E。接触0.5小时，游离性余氯不低于0.3mg/L

解析：本题考查氯化消毒的加氯量和接触时间。饮用水卫生标准规定，用氯消毒时，接触30分钟，有0.3～0.5mg/L的游离性余氯（E对CD错）；接触1～2小时后，有1～2mg/L化合性余氯（AB错）。